针灸治疗蛇串疮，应主选的经穴是
A. 足阳明、足厥阴经
B. 足厥阴、足太阳经
C. 手阳明、足阳明经
D. 手阳明、足太阴经
E. 局部穴、相应夹脊穴

正确答案：E。局部穴、相应夹脊穴

解析：蛇串疮主穴是夹脊穴、支沟、阳陵泉、行间，相应节段夹脊穴调畅患部气血。支沟属手少阳三焦经，阳陵泉属足少阳胆经，行间属足厥阴肝经（E对）。